男，32岁。发热，T39.5℃，腹痛，腹泻全身乏力，询问病史常在街边小摊进食，查体精神淡漠，P88次/分。则患者的病理不包括
A. 大量浆液分泌亢进
B. 黏膜水肿
C. 巨噬细胞浸润
D. 黏膜下有凹空细胞
E. 中性粒细胞浸润

正确答案：D。黏膜下有凹空细胞

解析：青年男性患者，发热、腹泻乏力，伴有长期不洁饮食史，精神淡漠，诊断考虑细菌性痢疾。细菌性痢疾早期早期粘液分泌亢进（A对），黏膜充血、水肿（B对）、中性粒细胞和巨噬细胞浸润（CE对），可见点状出血。病变进一步发展则出现黏膜浅表坏死，渗出物中含有大量纤维素，表现为典型的地图样坏死灶与伪膜性肠炎。凹空细胞（D错，为本题正确答案）见于尖锐湿疣患者病变黏膜表现层，较正常细胞大，胞浆空泡状，细胞边缘常存带状胞浆，核增大居中，圆形，椭圆形或不规则形，染色深。